用纱布、棉花蘸取后用于皮肤或口、喉黏膜的液体制剂
A. 泻下灌肠剂
B. 含药灌肠剂
C. 涂剂
D. 灌洗剂
E. 洗剂

正确答案：C。涂剂